女，25岁，孕40周，拟行剖宫产手术，既往体健，无输血史，入院后化验血：Hb70g/L，术前给予输注悬浮红细胞，开始输注30分钟后，出现皮肤瘙痒，出汗，呼吸困难，视物模糊，查体：T36.5℃，会厌水肿，应首先考虑
A. 输血相关移植物抗宿主反应
B. 过敏反应
C. 细菌污染反应
D. 输血后循环超负荷
E. 急性溶血性反应

正确答案：B。过敏反应

解析：输血30分钟后，出现皮肤瘙痒，出汗，呼吸困难，视物模糊，会厌水肿，首先考虑过敏反应（B对）。输血相关移植物抗宿主反应（A错）病人发病前常已有免疫力低下、低蛋白血症、淋巴细胞减少或骨髓抑制等异常。细菌污染反应（C错）临床表现有烦躁、寒战、高热、呼吸困难、恶心、呕吐、发绀、腹痛和休克。输血后循环超负荷（D错）表现为输血中或输血后突发心率加快、呼吸急促、发绀或咳吐血性泡沫痰。急性溶血性反应（E错）典型的症状为病人输入十几毫升血型不合的血后，立即出现沿输血静脉的红肿及疼痛，寒战、高热、呼吸困难、腰背酸痛、头痛、胸闷、心率加快乃至血压下降、休克，随之出现血红蛋白尿和溶血性黄疸（P22-24）。